不含手性碳，三苯哌嗪类钙通道阻滞剂，用于脑供血不足治疗的药物是
A. 硝苯地平
B. 苯磺酸氨氯地平
C. 盐酸氟桂利嗪
D. 盐酸维拉帕米
E. 盐酸地尔硫䓬

正确答案：C。盐酸氟桂利嗪

解析：本题考查盐酸氟桂利嗪的结构与临床应用。盐酸氟桂利嗪（C对）为三苯哌嗪类钙通道阻滞剂，用于脑供血不足。